莪术醇为莪术挥发油的主要成分之一，其结构类型是
A. 倍半萜
B. 半萜
C. 单萜
D. 二萜
E. 二倍半萜

正确答案：A。倍半萜

解析：本题考查的是含萜类化合物的成分的结构类型。莪术醇是倍半萜类化合物（A对）。萜类化合物是一类由甲戊二羟酸衍生而成，基本碳架多具有2个或2个以上异戊二烯单位（C5单位）结构特征的不同饱和程度的衍生物。按照分子中异戊二烯单位的数目可将萜类化合物分为单萜、倍半萜、二萜、二倍半萜、三萜、四萜及多萜。1.单萜（C错）：单萜是指基本碳架由2分子异戊二烯单位构成，含有10个碳原子的萜烯及其衍生物。单萜类化合物是挥发油的主要组成成分（单萜苷类不具随水蒸气蒸馏的性质），常存在于菊科、唇形科、樟科、桃金娘科、芸香科、伞形科、姜科、松科等植物的腺体、油室及树脂道等分泌组织内。昆虫和微生物的代谢产物以及海洋生物中也含有单萜。单萜类化合物有香叶醇、薄荷醇、龙脑等。2.倍半萜：倍半萜类是由3个异戊二烯单位构成的天然萜类化合物。倍半萜及其含氧化合物多与单萜类共存于植物挥发油中，是挥发油高沸程（250℃～280℃）的主要组分，也有低沸点的固体。在植物界中多以醇、酮、内酯或苷的形式存在。如金合欢醇、青蒿素、马桑毒素、羟基马桑毒素、莪术醇等。3.二萜（D错）：是指骨架由4个异戊二烯单位构成，含20个碳原子的一类萜类衍生物。绝大多数不能随水蒸气蒸馏。二萜多以树脂、内酯或苷等形式广泛存在于自然界。不少二萜含氧衍生物具有很好的生物活性，如穿心莲内酯、芫花酯、雷公藤内酯、银杏内酯、紫杉醇等。二倍半萜类（E错），2022年考试指南未明确说明。二倍半萜是指骨架由5个异戊二烯单位构成，含25个碳原子的一类萜类衍生物。主要分布在植物和海洋生物中，相对于其他萜类化合物结构较为稀少。